在确定固定修复体龈缘位置时，必须考虑的因素是
A. 美观
B. 固位
C. 牙冠外形
D. 年龄
E. 以上都对

正确答案：E。以上都对

解析：美观、固位、牙冠外形、年龄等都要作为固定修复体龈缘位置确定的考虑因素。掌握“修复体试戴、磨光与粘固”知识点。